下列关于双牙列的说法错误的是
A. 牙齿在一生中只能够替换一次
B. 分为乳牙列和恒牙列
C. 主要是槽生牙
D. 哺乳动物包括人类为双牙列
E. 去旧更新，终生不止

正确答案：E。去旧更新，终生不止

解析：双牙列：牙在一生中只替换一次，即乳牙列和恒牙列，故称为双牙列。双牙列主要是槽生牙，哺乳动物包括人类为双牙列。掌握“牙的演化”知识点。